分析资料是
A. 获得原始资料
B. 统计设计
C. 统计归纳，进行分组和汇总
D. 撰写文章
E. 计算统计指标，选择合适的检验方法并作出恰当的结论

正确答案：E。计算统计指标，选择合适的检验方法并作出恰当的结论

解析：分析资料是根据研究设计的目的、要求、资料的类型和分布特征选择正确的统计方法进行分析。包括两个方面：一是进行统计描述，即计算平均值、发病率等；二是进行统计推断，即推断总体的特征，如推断总体均数等。掌握“统计基本概念和步骤”知识点。